男孩2岁，生后6个月发现智能发育落后，8个月出现惊厥，尿有异味。查体：T36.5℃，P100次/分，R28次/分。目光呆滞，毛发棕黄，心肺腹未见明显异常，膝腱反射亢进。饮食治疗中需限制摄入量的氨基酸是
A. 色氨酸
B. 精氨酸
C. 酪氨酸
D. 赖氨酸
E. 苯丙氨酸

正确答案：E。苯丙氨酸

解析：2岁患儿，生后6个月发现智能发育落后，8个月出现惊厥（提示神经系统功能障碍），皮肤色泽变浅，头发变黄（提示有黑色素合成障碍）患儿尿液有异味（由于体液中排出较多苯乙酸所致），根据患儿临床表现和体征可初步诊断为苯丙酮尿症。正常人体内苯丙氨酸在苯丙氨酸羟化酶的作用下生成酪氨酸，酪氨酸可在酪氨酸羟化酶的作用下生成多巴胺、去甲肾上腺素等神经递质；也可在酪氨酸酶的作用下生成黑色素。缺乏苯丙氨酸羟化酶，苯丙氨酸不能被羟化生成酪氨酸，只能通过旁路代谢，由苯丙氨酸转氨酶催化生成苯丙酮酸，其代谢产物苯乙酸有明显的鼠尿臭味。由于患儿苯丙氨酸羟化酶缺乏，不能将苯丙氨酸转化为酪氨酸，所以要限制苯丙氨酸的摄入（E对）。